Graves病最重要的体征是
A. 皮肤湿润多汗，手颤
B. 眼裂增大，眼球突出
C. 弥漫性甲状腺肿大伴血管杂音
D. 收缩压升高，舒张压降低
E. 心脏扩大，心律不齐

正确答案：C。弥漫性甲状腺肿大伴血管杂音

解析：Graves病即弥漫性毒性甲状腺肿，甲状腺呈弥漫性对称性肿大，质地不等，左右叶上、下极可触及震颤伴血管杂音，为本病的特征之一（C对）。甲亢时，由于机体高代谢，产热增多，常有皮肤潮湿多汗；由于神经系统兴奋，可具有手颤、眼震（A错）。由于交感神经兴奋性升高，可出现眼球突出，眼裂增宽（B错）的单纯性突眼的体征。由于心血管功能亢进，可伴有窦性心动过速、心律不齐及心脏扩大（E错），收缩压升高、舒张压降低（D错）、脉压增大。A、B、D、E选项均可见于各种病因导致的甲亢（P680表7-10-1 甲状腺毒症的常见原因），无特异性。